他巴唑坦抑制β-内酰胺酶使头孢噻肟免受破坏属于
A. 敏感化作用
B. 拮抗作用
C. 无关作用
D. 增加毒性
E. 增加疗效

正确答案：E。增加疗效

解析：本题考查药物的联合应用。他巴唑坦抑制β-内酰胺酶使头孢噻肟免受破坏属于增加疗效（E对）。头孢噻肟属β-内酰胺类抗生素，β-内酰胺类抗生素可被β-内酰胺酶水解开环，进而失去药理作用；而他唑巴坦为β-内酰胺酶抑制剂，可有效降低β-内酰胺酶对药物的水解作用，提高疗效。敏感化作用（A错）是指一种药物可使组织或受体对另一种药物的敏感性增强。拮抗作用（B错）是指两种药物在同一或不同作用部位或受体上发生拮抗。无关作用（C错）最新版考试指南中未明确说明。增加毒性（D错）：氢溴酸山莨菪碱与哌替啶合用时可增加毒性。